某地区有10万人口，1960年总死亡人数1000名，已发现的结核病患者有300名，男性200名，女性有100名，1960年有60名死于结核病，其中50名为男性，结核病的死亡专率为
A. 60/10万
B. 300/10万
C. 200/1000
D. 0.2
E. 所给资料不能计算

正确答案：A。60/10万

解析：本题考查死亡专率的计算。结核病的死亡专率＝结核病死亡人数/同期平均人口数＝60/10万（A对BCDE错）。